某女，55岁，平素体虚，夏日不慎中暑，症见头晕身热、四肢倦怠、自汗心烦、咽干口渴。宜选用的成药是
A. 十滴水
B. 六合定中丸
C. 甘露消毒丸
D. 清暑益气丸
E. 藿香正气水

正确答案：D。清暑益气丸

解析：本题考查的是清暑益气丸的主治。平素体虚，夏日不慎中暑，症见头晕身热、四肢倦怠、自汗心烦、咽干口渴。宜选用的成药是清暑益气丸（D对）。清暑益气丸：【主治】中暑受热，气津两伤，症见头晕身热、四肢倦怠、自汗心烦、咽干口渴。十滴水（A错）：【主治】中暑，症见头晕、恶心、腹痛、胃肠不适。六合定中丸（B错）：【主治】夏伤暑湿，宿食停滞，寒热头痛，胸闷恶心，吐泻腹痛。甘露消毒丸（C错）：【主治】暑湿蕴结，身热肢酸、胸闷腹胀、尿赤黄疸。藿香正气水（E错）：【主治】外感风寒，内伤湿滞或夏伤暑湿所致的感冒，症见头痛昏重、胸膈痞闷、脘腹胀痛、呕吐泄泻；胃肠型感冒见上述证候者。